风湿病中最具诊断意义的病变是
A. 心肌局灶性变性、坏死
B. 心内膜纤维组织增生
C. 胶原纤维的纤维素样变性
D. Aschoff小体形成
E. 心外膜纤维素渗出

正确答案：D。Aschoff小体形成

解析：风湿病中，增生的巨噬细胞吞噬纤维素样坏死物质后转变成风湿细胞，成群的风湿细胞聚集于纤维素样坏死灶内，与少量的淋巴细胞和浆细胞构成Aschoff小体（风湿小体）（D对），此为最具诊断意义的病变。风湿病主要累及心肌间质、心瓣膜及心外膜，很少累及心肌细胞（A错）和心内膜（B错），累及心外膜且有纤维素渗出（E错）是绒毛心（P145）的特征性病变。